男性，55岁。下颌前牙出现剧烈疼痛、出血3天。口腔异味明显。患者吸烟多。口腔检查左右下43211234唇侧龈缘如虫蚀状，覆有灰褐色假膜，可擦去，留下出血面。龈乳头和边缘龈呈直线刀切状。无松动，无牙周袋。口腔内有特殊腐败臭味。颌下淋巴结肿大压痛。可能的诊断是
A. 急性白血病的牙龈表现
B. 急性龈乳头炎
C. 急性坏死溃疡性龈炎
D. 急性坏死溃疡性牙周炎
E. 急性疱疹性龈炎

正确答案：C。急性坏死溃疡性龈炎

解析：本题考查急性坏死性溃疡性龈炎的临床表现。根据题目中的信息下颌前牙及前磨牙唇侧龈缘如虫蚀状，覆有灰褐色假膜，可擦去，留下出血面，龈乳头和边缘龈呈直线刀切状，有特殊腐败臭味，颌下淋巴结肿大压痛，可诊断为急性坏死性溃疡性龈炎（C对）（ANUG）。急性白血病的牙龈病损表现为牙龈乳头、龈缘和附着龈牙龈肿大，颜色暗红、苍白，牙龈有明显的出血倾向，出血不止（A错）。急性龈乳头炎表现为牙龈乳头发红肿胀，探触和吸吮有出血，有自发性的胀痛和明显的探触痛，牙可有叩痛（B错）。急性坏死溃疡型龈炎若不及时治疗或存在某些免疫缺陷，病损可累及深层牙周组织引起牙槽骨吸收，牙周袋的形成和牙齿松动即为坏死溃疡性牙周炎（D错）。急性疱疹性龈炎为成簇的小水疱，疱破溃后成为大片浅表溃疡，可伴有皮肤损害（E错）。